中药品种一级保护的期限是
A. 6个月以内
B. 一年以内
C. 5年
D. 7年
E. 分别为30年、20年、10年

正确答案：E。分别为30年、20年、10年

解析：本题考查中药一级保护品种的保护期限。中药一级保护品种的保护期限分别为30年、20年、10年（E对），中药二级保护品种的保护期限为7年（D错）。